有机磷酸酯类中毒时，M样症状产生的原因是
A. 胆碱能神经递质释放增加
B. M胆碱受体敏感性增强
C. 直接兴奋M受体
D. 胆碱能神经递质破坏减少
E. 抑制Ach摄取

正确答案：D。胆碱能神经递质破坏减少

解析：有机磷酸酯类中毒后，体内AchE活性被抑制，胆碱能神经末梢释放的递质Ach不能被有效水解，从而导致Ach在体内大量堆积（D对）。